属于混悬型液体药剂的是
A. 薄荷水
B. 炉甘石洗剂
C. 胃蛋白酶溶液
D. 右旋糖酐注射液
E. 松节油搽剂

正确答案：B。炉甘石洗剂

解析：本题考查的是剂型按药物的分散状态分类。属于混悬型液体药剂的是炉甘石洗剂（B对）。按药物的分散状态分类，按分散相在分散介质中的分散特性将剂型分为：（1）真溶液型药物剂型：如芳香水剂（A错）、溶液剂、甘油剂、醑剂等。（2）胶体溶液型药物剂型：如胶浆剂、涂膜剂等。（3）乳浊液型药物剂型：如口服乳剂、静脉注射用乳剂、部分搽剂（E错）等。（4）混悬液型药物剂型：如洗剂、混悬剂等。中药制剂中汤剂、合剂（C错）等剂型，由于药物组成成分性质的复杂性，其中多成分的分散状态常常包含有真溶液型、胶体溶液型、乳浊液型或混悬液型等多分散体系。右旋糖酐注射液（D错）为胶体输液剂，属于胶体溶液型药物剂型。